男，20岁，苍白、乏力一周。淋巴结及脾大，白细胞计数32.0×10⁹/L，骨髓中原始细胞占83%，过氧化物酶染色阴性。最可能的诊断是
A. 急性早幼粒细胞白血病
B. 急性粒细胞白血病
C. 急性红白血病
D. 急性单核细胞白血病
E. 急性淋巴细胞白血病

正确答案：E。急性淋巴细胞白血病

解析：患者青年男性，苍白、乏力一周（贫血表现），查体：淋巴结及脾大（淋巴结肿大以急性淋巴细胞白血病ALL较多见），白细胞计数32.0×10⁹/L（正常4～10×10⁹/L）显著增高，骨髓中原始细胞占83％（FAB分型原始细胞≥30%，WHO分型≥20%即可诊断为急性白血病），过氧化物酶染色阴性（可见于急性淋巴细胞白血病或急性单核细胞白血病），故患者最可能的诊断为急性淋巴细胞白血病（E对）。急性早幼粒细胞白血病（A错）、急性粒细胞白血病（B错）过氧化物酶染色强阳性，一般无肝脾、淋巴结肿大；急性红白血病（C错）过氧化物酶染色视合并的白细胞类型而定；急性单核细胞白血病（P571）（D错）过氧化物酶染色阴性或弱阳性，常有牙龈增生、肿胀，皮肤蓝灰色斑丘疹等皮肤、黏膜改变，但肝脾、淋巴结肿大不如急性淋巴细胞白血病常见。